初孕妇自觉胎动，多数开始于
A. 妊娠12～14周
B. 妊娠15～17周
C. 妊娠18～20周
D. 妊娠21～23周
E. 妊娠24～26周

正确答案：C。妊娠18～20周

解析：胎动一般在妊娠18周后B型超声检查可发现，初孕妇于妊娠20周可感到胎动（C对），经产妇感觉略早于初产妇。